过清音见于
A. 叩击富有弹性、含气量正常的肺组织所从产生的音响
B. 叩击含有大量气体的空腔脏器时出现
C. 叩击含气量增多、弹性减退的肺组织时
D. 出现叩击不含气的实质性脏器时出现
E. 叩击各种原因所致含气减少的肺组织时出现

正确答案：C。叩击含气量增多、弹性减退的肺组织时

解析：过清音是属于鼓音范畴的一种变音，介于鼓音与清音之间，过清音出现提示肺组织含气量过多，弹性减弱（C对），临床上常见于肺气肿。叩击富有弹性、含气量正常的肺组织时（A错）为清音。叩击含有大量气体的空腔脏器时（B错）为鼓音。叩击不含气的实质性脏器时（D错）为实音。叩击各种原因所致含气减少的肺组织时（E错）为浊音或实音。